青年男性，无痛性颈部淋巴结肿大1月余，起病来伴发热盗汗，皮肤瘙痒等症状；查体淋巴结质坚有弹性，融合；活检示淋巴结结构破坏，可见里-斯细胞。可诊断为
A. 传染性单核细胞增多症
B. 淋巴结反应性增生
C. 霍奇金淋巴瘤
D. 非霍奇金淋巴瘤
E. 淋巴结结核

正确答案：C。霍奇金淋巴瘤

解析：活检发现里-斯细胞（R-S细胞）为霍奇金淋巴瘤的特点。掌握“淋巴瘤”知识点。